产后出血是指阴道流血量在胎儿娩出后24小时内超过
A. 300ml
B. 400ml
C. 500ml
D. 600ml
E. 700ml

正确答案：C。500ml

解析：产后出血指胎儿娩出后24小时内失血量超过500ml（C对），剖宫产时超过1000ml，是分娩期的严重并发症。